诊断试验的主要目的是
A. 将人群中的健康人与有病或可疑有病的人区别开来
B. 将人群中有病的人与可疑有病的人区别开来
C. 两者均是
D. 两者均否

正确答案：B。将人群中有病的人与可疑有病的人区别开来

解析：本题考查诊断试验的目的。诊断试验的主要目的是区分病人与可疑有病但实际无病的人（B对ACD错）。